胆固醇合成途径中的关键酶是
A. 果糖二磷酸酶-1
B. 6-磷酸果糖激酶-1
C. HMG-CoA还原酶
D. 磷酸化酶
E. HMG-CoA合成酶

正确答案：C。HMG-CoA还原酶

解析：胆固醇合成途径中的关键酶是HMG-CoA还原酶（C对）。果糖二磷酸酶-1（A错）是糖异生过程中的关键酶。6-磷酸果糖激酶（B错）是糖酵解途径的关键酶。磷酸化酶（D错）可将供体的磷酸基团转移到受体上，如糖原磷酸化酶，它是糖原分解过程中的关键酶。HMG-CoA合成酶（E错）参与酮体和胆固醇的合成，但不是关键酶。